处方中表示“必要时（长期备用）”的缩写是
A. qs.
B. prn
C. hs.
D. St.
E. sos.

正确答案：B。prn

解析：本题考查处方中常见的外文缩写及其含义。表示“必要时（长期备用）”的缩写是prn（B对）。qs.（A错）表示“适量”。hs.（C错）表示“临睡时”。St.（D错）表示“立即”。sos.（E错）表示“必要时（临时备用）”。